共同参与型的生物医学模式特征是
A. 医生为病人做什么
B. 医生教会病人做什么
C. 医生帮助病人自我恢复
D. 配合病人做什么
E. 告诉病人做什么

正确答案：C。医生帮助病人自我恢复

解析：共同参与型这是一种双向性的，以生物心理社会医学模式为指导思想的医患关系，其特征是“医生帮助病人自我恢复”，医患双方的关系建立在平等基础上，双方有近似相等的权利和地位，共同参与医疗决策和实施过程，相互尊重、相互依赖。掌握“医患沟通的理论、技术与其应用以及医患关系模式”知识点。